对江河水系进行应急监测时，在突发环境污染事件发生断面处设置的采样点称之为
A. 监测断面
B. 控制断面
C. 对照断面
D. 消减断面
E. 削减断面

正确答案：B。控制断面

解析：本题考查控制段面。对江河水系进行应急监测时，在突发环境污染事件发生断面处设置的采样点称之为控制段面（B对ACDE错）。